关于普查的目的，以下哪一项不正确
A. 早期发现病例
B. 检验病因
C. 了解疾病的分布
D. 为病因研究提供线索
E. 为开展疾病防制提供依据

正确答案：B。检验病因

解析：本题考查普查的目的。普查的目的包括：①早期发现病例（A对）；②了解疾病的分布（C对），为病因研究提供线索（D对）；③为开展疾病防制提供依据（E对）。检验病因（B错，为本题正确答案）是队列研究的重要特点，队列研究属于分析性研究，而普查属于描述性研究。